属于正治的是
A. 热因热用
B. 通因通用
C. 热者寒之
D. 用热远热
E. 以补开塞

正确答案：C。热者寒之

解析：热者寒之指即以寒治热，指用寒凉方药或具有寒凉功效的措訄而治疗热性病证的治法，属于正治法（C对）。热因热用属于反治（A错）；通因通用属于反治（B错）；用热远热属于三因制宜（D错）；以补开塞即塞因塞用，属于反治（E错）。